重酒石酸去甲肾上腺素的含量测定方法为
A. 中和滴定法
B. 双相滴定法
C. 非水溶液滴定法
D. 络合滴定法
E. 高锰酸钾滴定法

正确答案：C。非水溶液滴定法

解析：本题考查非水溶液滴定法。非水溶液滴定法（C对）是以质子传递反应为基础的在水以外的溶剂中滴定的方法。可测定有机弱碱及其盐类，以及有机酸的碱金属盐等药物。例如，地西泮、重酒石酸去甲肾上腺素、水杨酸钠。中和滴定法（A错）是指利用溶液的酸碱性变化而指示反应终点的分析方法，如阿司匹林的含量测定。双相滴定法（B错）是指采用两种互不相溶的溶剂在分液漏斗中进行的滴定，如苯甲酸钠。络合滴定法（D错）是以络合反应为基础的滴定分析方法；高锰酸钾滴定法（E错）属于氧化还原滴定法。